患者，男，58岁，有高血压、冠心病、高脂症、便秘、骨关节炎和胃溃疡病史，2年前接受冠脉支架植入术。近日，患者先后在心内科、消化科、骨科就诊，开具药品如下：酒石酸美托洛尔片、阿司匹林肠溶片、单硝酸异山梨酯片、阿托伐他汀钙片、聚乙二醇4000散、双氯芬酸钠缓释片、奥美拉唑肠溶片、麝香保心丸和复方丹参片。患者既往使用单硝酸异山梨酯缓释片，此次就诊医师开具单硝酸异山梨酯片。关于该患者用药教育的说法，错误的是
A. 规律使用硝酸酯类药物有助于预防心绞痛发作
B. 单硝酸异山梨酯片每天早晚各服片（20mg），应间隔12小时
C. 使用西地那非24小时内不可应用单硝酸异山梨酯片，避免引起严重低血压
D. 单硝酸异山梨酯缓释片与普通片均不适于心绞急性发作的治疗
E. 硝酸酯类药物可引起心率反射性加快

正确答案：B。单硝酸异山梨酯片每天早晚各服片（20mg），应间隔12小时

解析：本题考查单硝酸异山梨酯给药剂量与频次。为减少耐药性的发生，长期使用硝酸酯类药物应偏心给药，保证每天8～12小时的无硝酸酯或低硝酸酯浓度时间，单硝酸异山梨酯普通片20mg，bid；缓释片40～60mg，qd（B错，为本题正确答案）。